肾中精气的主要生理功能是
A. 促进机体的生长发育
B. 促进生殖功能的成熟
C. 主生长发育和生殖
D. 化生血液
E. 人体生命活动的根本

正确答案：C。主生长发育和生殖

解析：肾精、肾气能够促进机体生长发育与生殖机能成熟（C对）（AB错）。化生血液是脾的功能（D错）。气、血，津液，是构成人体的基本物质，是脏腑、经络，组织、器官进行生理话动的基础，是维持人体生命活动不可缺少的物质，是人体生命活动的根本（E错）。